具有降逆止呕功效的药物是
A. 白前
B. 旋覆花
C. 桔梗
D. 前胡
E. 白芥子

正确答案：B。旋覆花

解析：该题考查旋覆花的功效。旋覆花味苦、辛、咸，性微温，归肺、胃经，其功效为降气化痰，降逆止呕（B对）。